治疗小儿哮喘外寒内热证的方剂是
A. 小青龙汤合三子养亲汤
B. 麻杏石甘汤
C. 大青龙汤
D. 苏子降气汤
E. 人参五味子汤

正确答案：C。大青龙汤

解析：小儿哮喘外寒内热证之外寒多由外感风寒所致；其内热常因外邪入里化热或 素蕴之痰饮郁遏而化热或平素体内有热邪蕴积，被外邪引动而诱发，故治疗时应解表清里，定喘止咳，选方大青龙汤（C对）。小青龙汤合三子养亲汤（A错）其功用为温肺散寒，化痰定喘，适用于寒性哮喘。麻杏石甘汤（B错）其功用为辛凉疏表，清肺平喘，适用于热性哮喘。苏子降气汤（D错）其功用为降气平喘，祛痰止咳，适用于肺实肾虚之偏于上盛者。人参五味子汤（E错）其功用为益气健脾，适用于脾气虚者。